赤石脂的功效是
A. 化瘀止血
B. 涩肠止带
C. 敛肺涩肠
D. 补脾止泻
E. 补肾助阳

正确答案：B。涩肠止带

解析：本题考查的是赤石脂的功效。赤石脂的功效是涩肠止带（B对）。赤石脂：【功效】涩肠止泻，止血，止带；外用收湿敛疮生肌。血竭：【功效】活血定痛，化瘀止血（A错），生肌敛疮。乌梅：【功效】敛肺，涩肠（C错），生津，安蛔，止血。莲子肉：【功效】补脾止泻（D错），益肾固精，止带，养心安神。桑螵蛸：【功效】固精缩尿，补肾助阳（E错）。